34岁经产妇，妇科检查：宫颈中度糜烂，宫颈口松弛，子宫后倾屈，双附件未扪及。易选择的避孕方法是
A. 口服短期避孕药
B. 阴茎套
C. 安全期避孕
D. 宫内节育器
E. 体外排精

正确答案：A。口服短期避孕药

解析：该患者为青年经产妇，处于生育后期，避孕方式选择的原则是：选择长效、安全、可靠的避孕方法，减少非意愿妊娠进行手术带来的痛苦。各种避孕方法（宫内节育器、皮下埋植剂、复方口服避孕药、避孕针、阴茎套等）均适用，根据个人身体状况进行选择。患者妇检宫颈口松弛，不适宜用宫内节育器（D错），且患者宫颈中度糜烂，有研究表明，阴茎套与宫颈糜烂发生有关，还可加重且发展，故不适宜选用阴茎套（B错）。安全期避孕法（C错）又称自然避孕法，并不十分可靠，不宜推广。体外排精（E错）掌握不当会在阴道内遗留一部分精液，从而导致避孕失败。该患者易选择的避孕方法是口服短期避孕药（A对），且该方法使用方便，避孕效果好，不影响性生活。